含咖啡因的中成药
A. 金羚感冒片
B. 桑菊感冒片
C. 感冒灵胶囊
D. 荆防颗粒
E. 玉屏风颗粒

正确答案：C。感冒灵胶囊

解析：本题考查含西药组分的中成药品种。含咖啡因的中成药是感冒灵胶囊（C对）。感冒灵胶囊含西药组分：对乙酰氨基酚、马来酸氯苯那敏、咖啡因。金羚感冒片（A错）含西药组分：阿司匹林、马来酸氯苯那敏、维生素C。桑菊感冒片（B错）【主治】风热感冒初起，头痛，咳嗽，口干，咽痛。【注意事项】风寒外感者慎用。服药期间，忌食辛辣、油腻食物。荆防颗粒（D错）【主治】外感风寒挟湿所致的感冒，症见头身疼痛、恶寒无汗、鼻塞流涕、咳嗽。【注意事项】风热感冒或湿热证慎用。服药期间，忌食辛辣、生冷、油腻食物。玉屏风颗粒（E错）【主治】表虚不固所致的自汗，症见自汗恶风、面色㿠白，或体虚易感风邪者。【注意事项】热病汗出、阴虚盗汗者慎用。服药期间，饮食宜清淡。